有关医院感染的概念，错误的是
A. 在医院内获得的感染
B. 出院之后的感染有可能是医院感染
C. 入院时处于潜伏期的感染一定不是医院感染
D. 与上次住院有关的感染是医院感染
E. 婴幼儿经胎盘获得的感染是医院感染

正确答案：E。婴幼儿经胎盘获得的感染是医院感染

解析：院内感染指在医院内获得的感染（A对），与上次住院有关的感染也为院内感染（D对），包括在住院期间发生的感染和在医院内获得但在出院后发生的感染（B对），有明确潜伏期的感染，自入院时起超过平均潜伏期后发生的感染为医院感染，入院时处于潜伏期的感染一定不是医院感染（C对）。婴幼儿经胎盘获得的感染不是院内感染，属于母婴垂直传播（E错，为本题正确答案）。